月经先后不定期的主要发病机制是
A. 肝郁气滞，疏泄失调
B. 肾气不足，封藏失职
C. 脾气虚弱，统摄无权
D. 湿热下注，任带不固
E. 气血失调,血海蓄溢失常

正确答案：E。气血失调,血海蓄溢失常

解析：月经先后不定期  本病发病机理，在于肝肾功能失常，肝藏血，司血海，肝气逆乱，疏泄失司，冲任失调，气血失于调节而导致血海蓄失常；肾主封藏，主施泄，肾气亏损，藏泄失司，冲任失调，血海蓄溢失常（E对）。肝有气滞，疏泄失司，冲任失调，疏泄太过，则月经先期而至；疏泄不及则月经后期而至，肝有气滞，疏泄失调属于月经先后不定期的病因，非发病机制（A错）。肾气不足，藏泄失司，冲任失调，血海蓄溢失常，若应藏不藏则月经先期而至，当泻不泻则月经后期而至，肾气不足，封藏失职属于月经先后不定期的病因，非发病机制（B错）。脾气虚弱，统摄无权，冲任亏虚而不固，可出现月经过多、经期延长、崩漏、胎漏、产后恶露不绝及乳汁子处，不会导致月经先后不定期（C错）。湿热下注，流注下焦，损伤任带二脉致带下过多，不会导致月经先后不定期（D错）。